典型不良反应为皮肤毒性，属于酪氨酸激酶抑制剂的药物是
A. 顺铂
B. 吉非替尼
C. 奥沙利铂
D. 氟尿嘧啶
E. 卡铂

正确答案：B。吉非替尼

解析：本题考查吉非替尼。典型不良反应为皮肤毒性，属于酪氨酸激酶抑制剂的药物是吉非替尼（B对）。顺铂（A错）典型不良反应为恶心、呕吐、肾毒性和耳毒性。卡铂（E错）引起的恶心和呕吐的严重程度比顺铂轻，引起肾毒性和耳毒性不良反应比顺铂少，但骨髓抑制比顺铂严重。奥沙利铂（C错）引起恶心、呕吐、肾毒性、耳毒性、骨髓抑制均较轻，但神经毒性强。氟尿嘧啶（D错）典型不良反应为心脏毒性。